患者左上7中龋，进行银汞充填修复，医师应注意的事项不包括
A. 必须以氧化锌垫底
B. 充填并雕刻成形必须在6、7分钟内完成
C. 修复体边缘不形成菲薄边缘
D. 医嘱24小时内勿用该牙咀嚼
E. 可以聚羧酸锌垫底

正确答案：A。必须以氧化锌垫底

解析：本题考查银汞充填修复的注意事项。患者左上7中龋，进行银汞充填修复，医师应注意的事项不包括必须以氧化锌垫底（A错，为本题的正确答案）。氧化锌强度较低，不足以承受咀嚼压力，用于银汞合金充填垫底，在承受咀嚼压力时易折裂。银汞合金从调制到填充完毕必须在6、7分钟内完成（B对），如搁置时间过长，调制的银汞合金会变硬，可塑性降低，影响材料与洞壁的密合。为防止修复后边缘折断，修复体边缘不应形成菲薄边缘（C对）。银汞合金24小时后完全固化，尚未完全硬固时，不能承受咀嚼压力，应嘱咐患者24小时内勿用该牙咀嚼（D对）。聚羧酸锌强度较高，可用于银汞合金充填时的直接垫底（E对）。